根据TNM分期标准，膀胱肿瘤浸润浅肌层的分期是
A. T1期
B. T2b期
C. T3a期
D. Ta期
E. T2a期

正确答案：E。T2a期

解析：根据肿瘤浸润深度，膀胱癌的TNM分期如下：Tis指原位癌；Ta（D错）指无浸润的乳头状癌；T1（A错）指肿瘤浸润黏膜固有层；T2（B错）指肿瘤浸润肌层，又可分为T2a（E对）浸润浅肌层（肌层内1/2），T2b浸润深肌层（肌层外1/2）；T3指肿瘤浸润膀胱周围脂肪组织，又可分为T3a（C错）显微镜下发现肿瘤侵犯膀胱周围组织，T3b肉眼可见肿瘤侵犯膀胱周围组织；T4浸润前列腺、子宫、阴道及盆壁等邻近器官。